固定义齿选择基牙时，以下哪种说法不确切
A. 牙冠长大
B. 牙根长大
C. 活髓牙
D. 牙周健康
E. 基牙位置正常

正确答案：A。牙冠长大

解析：固定桥基牙选择时，作为固定桥基牙的临床牙冠高度应适宜。如牙冠已有牙体组织缺损，或牙冠形态不正常，只要不影响固位体的固位形预备，并能达到固位体固位要求，亦可考虑作为基牙。牙冠缺损面积大，如果能通过桩核修复，仍可选为基牙。若基牙的临床牙冠过短，应采取增强固位体的固位力措施，如在基牙上制备辅助固位形或增加基牙数，否则不宜作固定桥修复。如果牙冠长大，但是牙根短小，依然不适合作为桥基牙。掌握“固定桥的生理基础”知识点。